“春夏养阳，秋冬养阴”，语出
A. 《素问·阴阳应象大论》
B. 《素问·六节藏象论》
C. 《素问·上古天真论》
D. 《素问·四气调神大论》
E. 《素问·生气通天论》

正确答案：D。《素问·四气调神大论》

解析：“春夏养阳，秋冬养阴”出自《素问·四七调神大论》，本义是指春夏养阳，即养生养长，秋冬养阴，即养收养藏。春夏阳气生长，养生应助养阳气；秋冬阳气收藏，养生应蓄养阴精（D对）。